下列哪项方法属于湿热灭菌法
A. 焚烧法
B. 烧灼法
C. 巴氏消毒法
D. 紫外线消毒法
E. 酒精消毒法

正确答案：C。巴氏消毒法

解析：湿热灭菌法包括巴氏消毒法、煮沸法和高压蒸汽灭菌法。掌握“消毒与灭菌”知识点。